我国慢性肾衰竭的最常见病因是
A. 急性肾炎
B. 慢性肾小球肾炎
C. 糖尿病肾病
D. 慢性肾盂肾炎
E. 高血压

正确答案：B。慢性肾小球肾炎

解析：慢性肾衰竭按病因分为原发性肾病、继发性肾病和尿路梗阻性肾病。在发达国家，糖尿病肾病、高血压肾小动脉硬化是慢性肾衰竭的主要病因。我国现在引起慢性肾衰竭的病因最常见的是慢性肾小球肾炎（B对）。